女，25岁。妊娠7个月，发热，腰痛伴恶心、呕吐、尿频、尿急、尿痛1天，查体：T38.5℃，左肾区叩击痛。血常规WBC11.9×10⁹/L，N0.82，尿常规RBC5～8/HP，WBC30～35/HP，尿蛋白（±）。最可能的诊断是
A. 急性胰腺炎
B. 急性肾小球肾炎
C. 急性膀胱炎
D. 急性肾盂肾炎
E. 急性胃肠炎

正确答案：D。急性肾盂肾炎

解析：患者青年女性（急性肾盂肾炎的好发人群），表现为全身感染中毒症状（发热，腰痛伴恶心，呕吐）及尿路刺激征（尿频尿急尿痛）1天，查体T38.5℃（有尿感表现且T＞38℃则应考虑上尿路上尿路感染），左肾区叩击痛，血常规WBC11.9×10⁹/L，N0.82（提示急性细菌感染），尿常规RBC5～8/HP，WBC30～35/HP（提示尿路感染），尿蛋白（±）。综合患者的年龄、性别、临床表现、体查及实验室检查，最可能的诊断是急性肾盂肾炎（D对）。急性胰腺炎（A错）、急性肾小球肾炎（B错）、急性胃肠炎（E错）没有尿频尿急尿痛的症状。急性膀胱炎（C错）无腰疼及全身感染中毒症状，且温度常低于38℃。